胃酸分泌增多较明显的疾病是
A. 慢性浅表性胃炎
B. 十二指肠溃疡
C. 慢性萎缩性胃炎
D. 反流性食管炎
E. 胃溃疡

正确答案：B。十二指肠溃疡

解析：十二指肠溃疡由于受迷走神经刺激导致胃酸分泌较胃溃疡多（B对E错）；胃酸由位于胃体的壁细胞分泌，慢性浅表性胃炎（A错）（慢性非萎缩性胃炎）壁细胞不受影响，胃酸分泌正常。慢性萎缩性胃炎（C错）以胃粘膜萎缩变薄，粘膜腺体较少或消失为主，胃酸分泌降低。反流性食管炎（D错）的主要病因是LES功能障碍，胃酸增多也不明显。